用于治疗结核的药物
A. 氯霉素
B. 青霉素
C. 羧苄青霉素
D. 四环素
E. 利福平

正确答案：E。利福平

解析：本题考查利福平。用于治疗结核的药物是利福平（E对）。利福平为一线抗结核药，其他同类药物还有异烟肼、吡嗪酰胺、乙胺丁醇。氯霉素（A错）为氯霉素类抗生素。青霉素（B错）、羧苄青霉素（C错）为β-内酰胺类抗生素。四环素（D错）为四环素类抗生素。